下面哪一项不是吸烟产生的主要有害物质
A. 潜在致癌性物质
B. 一氧化碳
C. 尼古丁
D. 氮氧化物
E. 焦油

正确答案：D。氮氧化物